男，56岁。高空坠落伤。查体：呼吸困难，颈部压痛，双肺闻及痰鸣音，四肢瘫痪。X线片显示C₄～C₅骨折脱位。首先采取的治疗措施是
A. 颈托制动
B. 颔枕带牵引
C. 气管切开
D. 手术复位固定
E. 应用呼吸兴奋剂

正确答案：C。气管切开

解析：患者高空坠落史，表现为颈部压痛、四肢瘫痪，呼吸困难、双肺闻及痰鸣音（提示出现膈神经损伤），X线片示C4～5骨折脱位，应诊断为C4～5骨折脱位、脊髓损伤。C4～5骨折脱位损伤的是膈神经（由3、4、5对颈神经的前支组成）的主要组成部分，膈神经损伤后膈肌功能瘫痪，导致呼吸困难，若不及时气管切开控制呼吸，将危及生命（C对）。颈托制动（A错）、颔枕带牵引（B错）、手术复位（D错）应在解决呼吸问题、保证生命体征稳定的基础上进行。呼吸兴奋剂属中枢兴奋药，在膈肌瘫痪的情况下应用没有效果（E错）。